游离的黄酮苷元难溶或不溶于
A. 甲醇
B. 丙酮
C. 苯
D. 乙酸乙酯
E. 水

正确答案：E。水

解析：本题考查的是黄酮类化合物的溶解性。游离的黄酮苷元难溶或不溶于水（E对）。黄酮类化合物的溶解度因结构及存在状态（苷或苷元、单糖苷、双糖苷或三糖苷）不同而有很大差异。一般游离苷元难溶或不溶于水，易溶于甲醇（A错）、乙醇、乙酸乙酯（D错）、乙醚等有机溶剂（BC错）及稀碱水溶液中。